下列关于DNA变性的说法，正确的是
A. DNA变性之后，不能重新合成双链
B. 连接DNA的磷酸二酯键断裂
C. DNA变性是由于两条链之间的氢键断裂
D. DNA变性后，两条单链不会形成杂化双链
E. DNA变性是由于两条链之间的磷酸二酯键断裂

正确答案：C。DNA变性是由于两条链之间的氢键断裂

解析：某些极端的理化条件（温度、pH、离子强度等）可以断裂DNA双链互补碱基对之间的氢键以及破坏碱基堆积力，使一条DNA双链解离成为两条单链。这种现象称为DNA变性（C对）。